氟西汀在体内生成仍具有活性的代谢物去甲氟西汀，发生的代谢反应是
A. 芳环羟基化
B. 硝基还原
C. 烯烃氧化
D. N-脱烷基化
E. 乙酰化

正确答案：D。N-脱烷基化

解析：本题考查5-羟色胺（5-HT）再摄取抑制剂。氟西汀在体内生成仍具有活性的代谢物去甲氟西汀，发生的代谢反应是N-脱烷基化（D对）。根据两者的结构，去甲氟西汀是氟西汀的N上脱去一个甲基的产物。